急性失血时最先出现的调节反应是
A. 血管的自身调节
B. 交感神经兴奋
C. 迷走神经兴奋
D. 血中血管升压素增多
E. 血中血管紧张素Ⅱ增多

正确答案：B。交感神经兴奋

解析：急性失血时最先出现的调节反应是交感神经兴奋（B对）。神经调节比较迅速、精确而短暂，急性失血时，交感神经系统活动增强（C错），机体出现心率加速、皮肤与腹腔内脏血管收缩等反应。血管的自身调节（A错）属于后期出现的代偿反应。血中血管升压素增多（D错）与血中血管紧张素Ⅱ增多（E错）属于体液调节，其相对缓慢、持久而弥散。